根据2013年1月发布的《药品经营质量管理规范》，某药品零售企业在员工请假需要调班时，不得由其他岗位人员代为履行职责的岗位有
A. 质量管理岗位
B. 质量验收岗位
C. 处方审核岗位
D. 处方调配岗位
E. 药学服务岗位

正确答案：A、C。质量管理岗位；处方审核岗位

解析：本题考查的是药品零售企业药品经营质量管理规范。根据2013年1月发布的《药品经营质量管理规范》，某药品零售企业在员工请假需要调班时，不得由其他岗位人员代为履行职责的岗位有质量管理岗位（A对）与处方审核岗位（C对）。药品零售企业经营和质量管理人员的岗位职责：企业应当明确企业负责人、质量管理、采购、验收、营业员以及处方审核、调配等岗位的职责，设置库房的还应当包括储存、养护等岗位职责。质量管理岗位、处方审核岗位的职责不得由其他岗位人员代为履行。